他汀类药物引起的典型药源性疾病是
A. 胃肠类疾病
B. 肌痛
C. 神经系统疾病
D. 血液系统疾病
E. 心血管系统疾病

正确答案：B。肌痛

解析：本题考查他汀类药物的不良反应。他汀类药物引起的典型药源性疾病是肌痛（B对）。他汀类为羟甲戊二酰辅酶A还原酶抑制剂，不良反应包括肌痛、横纹肌溶解症、多形性红斑等。